下列不属于社会卫生策略与措施的是
A. 社区卫生服务
B. 供应安全饮用水
C. 医疗技术措施
D. 合理配置卫生资源
E. 突发公共卫生应急机制

正确答案：C。医疗技术措施